下列描述不正确的是
A. 各级卫生防疫机构，负责管辖范围内的公共场所卫生监督工作
B. 公共场所卫生监督员执行卫生防疫机构交给的任务
C. 公共场所卫生监督员由同级人民政府发给证书
D. 铁路卫生防疫机构的公共场所卫生监督员，由其上级主管部门发给证书
E. 卫生许可证由省级以上卫生行政部门签发

正确答案：E。卫生许可证由省级以上卫生行政部门签发